患者因上前牙有洞要求治疗。检查：左右上1近中面龋，冷测一过性敏感，热测同对照牙，去腐后达牙本质深层，该患者牙最佳处理为
A. Ca（OH）₂制剂护髓，光敏树脂充填
B. Ca（OH）₂制剂护髓，玻璃离子水门汀垫底，光敏树脂充填
C. Ca（OH）₂制剂护髓，磷酸水门汀充填
D. 光敏树脂充填
E. Ca（OH）₂制剂护髓，玻璃离子水门汀充填

正确答案：B。Ca（OH）₂制剂护髓，玻璃离子水门汀垫底，光敏树脂充填

解析：本题考查深龋的治疗。患者因上前牙有洞要求治疗。检查：左右上1近中面龋，冷测一过性敏感，热测同对照牙，去腐后达牙本质深层，该患者牙最佳处理为Ca（OH）₂制剂护髓，玻璃离子水门汀垫底，光敏树脂充填（B对）。患牙去腐后达牙本质深层，考虑为深龋，应做垫底处理（ACDE错），用氢氧化钙衬洞，以促进修复性牙本质形成，然后用垫底材料垫底，考虑到美观因素，用光敏树脂充填美观效果最佳，综合看来，该患牙最佳处理为：Ca（OH）₂制剂护髓，玻璃离子水门汀垫底，光敏树脂充填。磷酸锌水门汀充填适用于牙体缺损的暂时性和中期充填修复，一般不用于永久性充填。玻璃离子水门汀充填的美观性不如光敏树脂好，并不是最佳处理。